引起慢性肾衰竭常见的病因是
A. 血栓性微血管病
B. 糖尿病肾病
C. 误中蛇毒
D. 休克早期
E. 药物过敏

正确答案：B。糖尿病肾病

解析：引起慢性肾衰竭常见的病因是糖尿病肾病（B对）。